下列关于血压的测量正确的是
A. 测量安静休息坐位时上臂肱动脉部位血压
B. 测量安静休息坐位时上臂肱静脉部位血压
C. 测量安静休息坐位时桡动脉部位血压
D. 测量安静休息坐位时桡静脉部位血压
E. 测量安静休息坐位时颈动脉部位血压

正确答案：A。测量安静休息坐位时上臂肱动脉部位血压

解析：高血压诊断主要根据诊室测量的血压值，采用经核准的水银柱或电子血压计，测量安静休息坐位时上臂肱动脉部位血压。必要时，如疑似直立性低血压的患者还应测量平卧位和站立位血压。高血压的诊断必须是在未用降压药物情况下2次以上非同日多次血压测定所得的平均值为依据。掌握“原发性高血压”知识点。